薏苡仁的性状鉴别特征有
A. 呈圆球形
B. 表面乳白色
C. 背面圆凸，腹面有 1条深而宽的腹沟
D. 质坚实，断面白色，有粉性
E. 气香浓郁，味甘淡

正确答案：B、C、D。表面乳白色；背面圆凸，腹面有 1条深而宽的腹沟；质坚实，断面白色，有粉性